参与B细胞活化的CD分子是
A. CD3
B. CD4
C. CD40
D. CD8
E. CD28

正确答案：C。CD40